不属于肉芽肿性炎的疾病是
A. 梅毒
B. 伤寒
C. 淋病
D. 血吸虫病
E. 结核病

正确答案：C。淋病

解析：肉芽肿性炎是以肉芽肿形成为特征的特殊类型慢性炎症，包括梅毒（A对）、血吸虫病（D对）和结核病（E对）等。淋病（P363）（C错，为本题正确答案）是由淋球菌引起的急性化脓性炎。伤寒是由伤寒杆菌引起的急性增生性炎，虽然其特征性病变也是伤寒肉芽肿，但伤寒肉芽肿的形成是急性过程，故B选项是错误的，也应为正确答案，此题不严谨。